女，30岁。低热，右下腹痛、腹泻伴粘液便9个月，消瘦贫血，右下腹压痛。血沉34mm／h，钡餐检查：回肠末段有三段肠壁僵硬狭窄，皱襞粗乱，有“卵石样”充盈缺损及“线样征”，诊断为
A. 肠易激综合征
B. 肠结核
C. Crohn病
D. 溃疡性结肠炎
E. 结肠癌

正确答案：C。Crohn病

解析：中青年女性患者，右下腹痛（Crohn病腹痛常位于右下腹或脐周）、腹泻伴黏液便9个月。低热、消瘦、贫血（Crohn病常见的全身表现）。体检：右下腹压痛。实验室检查：血沉增高（女性正常值0～20mm/h），提示疾病处于活动期。钡餐检查：回肠末段有三段肠壁僵硬狭窄，皱襞粗乱，有“卵石样”充盈缺损及“线样征”（Crohn病的特征性表现）。综合该患者的病史、实验室及钡剂灌肠检查，考虑诊断为Crohn病（C对）。肠易激综合征（P386）（A错）以腹痛或腹部不适伴排便习惯改变为特征，钡剂灌肠检查无明显改变。肠结核（P368）（B错）包括溃疡型肠结核和增生型肠结核，溃疡型肠结核常有结核毒血症状，表现为腹痛、腹泻，钡剂灌肠检查示回盲部黏膜粗乱，充盈不佳，呈“跳跃征”；增生型肠结核多有腹部肿块，以便秘为主，钡剂灌肠检查示肠腔变窄、肠段缩短变形、回肠和盲肠的正常角度消失。溃疡性结肠炎（P374）（D错）临床以反复发作的腹泻、黏液脓血便、左下腹或下腹阵痛为特征，钡餐检查可见黏膜颗粒样改变、多发性浅溃疡及铅管征。结肠癌（P382）（E错）多发于老年患者，排便习惯与粪便性状改变常为本病最早出现的症状，钡剂灌肠可发现充盈缺损、肠腔狭窄、黏膜皱襞破坏等征象，显示癌肿部位和范围。